甘露糖结合凝集素途径的激活物是
A. IgG或IgM
B. C3b
C. MBL
D. CR
E. 酵母多糖类

正确答案：C。MBL

解析：凝集素途径是由甘露糖结合凝集素（MBL）启动的补体激活途径。掌握“补体的概念，激活途径及调节”知识点。